骨折功能复位标准，正确的说法是
A. 长骨干横骨折对位至少达3/4
B. 下肢侧方成角移位不需矫正
C. 前臂双骨折只需对位良好
D. 下肢缩短移位成人不超过2厘米
E. 旋转移位必需矫正

正确答案：E。旋转移位必需矫正

解析：对于不同的部位，有不同的功能复位要求。骨折部位的旋转移位、分离移位必须完全矫正（E对）。缩短移位在成人下肢骨折不超过1cm（D错）；儿童若无骨骺损伤，下肢缩短在2cm以内，在生长发育过程中可自行矫正。下肢骨折轻微的向前或向后成角，与关节活动方向一致，无需处理，日后可自行矫正；而向侧方成角移位，必须完全复位（B错）。前臂双骨折要求对位、对线均好，否则影响前臂旋转功能，而非只需对位良好（C错）。长骨干横行骨折，骨折端对位至少达1/3（A错），干骺端骨折至少应对为3/4。